按照传统斗谱编排的基本原则，宜放置在斗架下层的饮片是
A. 牡丹皮
B. 代代花
C. 苦杏仁
D. 地榆炭
E. 桃仁

正确答案：D。地榆炭

解析：本题考查的是斗谱编排的基本原则。按照传统斗谱编排的基本原则，宜放置在斗架下层的饮片是地榆炭（D对）。中药斗谱应根据中药的性能和中医处方用药的配伍规律以及医院饮片品种和使用频率、医院专科设置、医院用药特色、医师用药习惯等情况，按照知识性、科学性和方便性、安全性的原则进行设计，合理有序地存放。斗谱编排是否科学、合理，直接影响配方效率和质量，但一般都是根据各药使用的不同频率以及药物的性质而安排的。斗谱编排基本原则：（1）按饮片使用频率排序。常用药物应放在斗架的中上层，便于调剂操作。如黄芪、党参与甘草；当归、白芍与川芎；麦冬、天冬与北沙参；肉苁蓉、巴戟天与补骨脂；金银花、连翘与板蓝根；防风、荆芥与白芷；柴胡、葛根与升麻；砂仁、豆蔻与木香；黄芩、黄连与黄柏；厚朴、香附与延胡索；焦麦芽、焦山楂与焦神曲；酸枣仁、远志与柏子仁；苦杏仁（C错）、桔梗与桑白皮；天麻、钩藤与蒺藜；陈皮、枳壳与枳实；附子、干姜与肉桂；山药、泽泻与牡丹皮（A错）等。（2）按饮片的质地轻重排序。质地较轻且用量较少的药物，应放在斗架的高层。如月季花、白梅花与佛手花；玫瑰花、代代花（B错）与厚朴花；地骨皮、千年健与五加皮；络石藤、青风藤与海风藤；密蒙花、谷精草与木贼草等。质地沉重的矿石、化石、贝壳类药物和易于造成污染的药物（如炭药），多放在斗架的较下层。前者如磁石、赭石与紫石英，龙骨、龙齿与牡蛎，石决明、珍珠母与瓦楞子，石膏、寒水石与海蛤壳等；后者如藕节炭、茅根炭与地榆炭，大黄炭、黄芩炭与黄柏炭，艾炭、棕榈炭与蒲黄炭等。质地松泡且用量较大的药物，多放在斗架最低层的大药斗内。如芦根与茅根；茵陈与金钱草；白花蛇舌草与半枝莲；灯心草与通草；竹茹与丝瓜络；薄荷与桑叶；荷叶与荷梗。（3）按饮片药用部位或功效排列。如将饮片按其入药部位分为根茎、皮、花、果实种子、全草、动物、矿物等若干类，或按其功效分为止咳平喘类、理气类、清热类、活血化瘀类等若干类，每类饮片相对集中并逐类按一定顺序排列，这种斗谱排列的特点是分类清楚，便于熟悉记忆，适用于饮片品种少、配方量小的医院。（4）将同一处方中经常一起配伍应用的，如“相须”“相使”配伍的饮片、处方常用的“药对”药物可同放于一个斗中。如麻黄、桂枝；酸枣仁、远志；射干、北豆根；党参、黄芪；桃仁（E错）、红花；杜仲、续断；陈皮、青皮；泽泻、猪苓；山药、薏苡仁；板蓝根、大青叶；辛夷、苍耳子；火麻仁、郁李仁；羌活、独活；苍术、白术；麦冬、天冬；川乌、草乌；知母、浙贝母；蒲公英、紫花地丁；萹蓄、瞿麦；三棱、莪术；乳香、没药；小茴香、橘核。根据各医院、药房的实际情况和用药习惯，在实际编排斗谱时应灵活选择、应用上述原则，初步制定斗谱后，在实际工作中，可根据使用情况随时调整。